适用于农业用水区及一般景观要求水域
A. Ⅰ类水
B. Ⅱ类水
C. Ⅲ类水
D. Ⅳ类水
E. Ⅴ类水

正确答案：E。Ⅴ类水

解析：本题考查水域的功能。《地表水环境质最标准》（GB 3838-2002）依据地表水水域环境使用功能和保护目标，按功能高低依次划分为五类功能区：Ⅰ类主要适用于源头水、国家自然保护区；Ⅱ类主要适用于集中式生活饮用水地表水源地一级保护区、珍稀水生生物栖息地、鱼虾类产卵场、仔稚幼鱼的索饵场等；Ⅲ类主要适用于集中式生活饮用水地表水源地二级保护区、鱼虾类越冬场、洄游通道、水产养殖区等渔业水域及游泳区；Ⅳ类主要适用于一般工业用水区及人体非直接接触的娱乐用水区；V类（E对ABCD错）主要适用于农业用水区及一般景观要求水域。